羽扇豆烷属于
A. 四环三萜
B. 五环三萜
C. 四环四萜
D. 五环四萜
E. 六环三萜

正确答案：B。五环三萜

解析：本题考查的是三萜的分类。羽扇豆烷属于五环三萜（B对）。三萜：基本骨架由6个异戊二烯单位组成。三萜的种类很多，但以皂苷形式存在的三萜类型并不多，较为常见的有羊毛甾烷型、达玛烷型、齐墩果烷型、乌苏烷型和羽扇豆烷型，其中前两种属于四环三萜（A错），后三种则属于五环三萜。1.四环三萜：结构与甾醇很类似。主要有以下类型。（1）羊毛甾烷型，如猪苓酸A。（2）达玛烷型，如20（S）-原人参二醇。2.五环三萜：主要有以下类型。（1）齐墩果烷型，此类以齐墩果酸最为多见。（2）乌苏烷型，此类大多是乌苏酸的衍生物。（3）羽扇豆烷型，如羽扇豆种子中存在的羽扇豆醇，酸枣仁中分得的白桦醇和白桦酸等。